下述中哪一点不是环境流行病学研究的特点
A. 多因素
B. 弱效应
C. 非特异性
D. 以生物性致疾病为主
E. 潜隐期

正确答案：D。以生物性致疾病为主

解析：本题考查环境流行病学研究的特点。环境流行病学研究是一种研究环境因素与疾病发生之间关系的研究方法，其特点是多方面的，包括多因素（A对）、弱效应（B对）、非特异性（C对）、潜隐期（E对）等。以生物性致疾病为主（D错，为本题正确答案）不是环境流行病学研究的特点。